Ⅰ期临床试验阶段，试验样本数为
A. 小于10例
B. 20～30例
C. 200～300例
D. 1000～3000例
E. 大于2000例

正确答案：B。20～30例

解析：本题考查临床药理学研究。Ⅰ期临床试验阶段，试验样本数为20～30例（B对）。
Ⅰ期临床试验：试验对象主要为健康志愿者，试验样本数一般为20～30例。II期临床试验：试验对象为目标适应症患者，最低病例数(试验组)为100例。III期临床试验最低病例数（试验组）为300例。IV期临床试验为新药上市后的研究阶段，最低病例数（试验组）为2000例，生物等效性试验为18~24例。